根据形成苷键的原子分类，属于S-苷的是
A. 山慈菇苷
B. 萝卜苷
C. 巴豆苷
D. 天麻苷
E. 毛茛苷

正确答案：B。萝卜苷

解析：本题考查的是苷类分类方式。根据形成苷键的原子分类，属于S-苷的是萝卜苷（B对）。依据苷键原子的不同可将苷分为O-苷、S-苷、N-苷和C-苷。1.氧苷（O-苷）：以苷元不同，又可分为醇苷、酚苷、氰苷、酯苷和吲哚苷。（1）醇苷：如红景天苷、毛茛苷（E错）、獐牙菜苷。（2）酚苷：如天麻苷（D错）、水杨苷。（3）氰苷：如苦杏仁苷。（4）酯苷：如山慈菇苷A（A错）等。（5）吲哚苷：如靛苷。2.硫苷（S-苷）：如萝卜苷、芥子苷。3.氮苷（N-苷）：如巴豆苷（C错）。4.碳苷（C-苷）：如芦荟苷。